人工流产吸宫术适用于
A. 妊娠14周
B. 急性生殖道炎症
C. 各种慢性疾病的急性期
D. 手术当天体温两次超过37.5℃
E. 妊娠剧吐

正确答案：E。妊娠剧吐

解析：人工流产吸宫术适用于妊娠10周内（A错）要求终止妊娠而无禁忌症，患者有某种严重疾病不宜继续妊娠。妊娠剧吐（P81）（E对）患者应住院治疗，若病情持续进展，出现黄疸、持续蛋白尿等情况应终止妊娠，可选用人工流产吸宫术。人工流产吸宫术禁忌症包括：急性生殖道炎症（B错）；各种慢性疾病的急性期（C错）；手术当天体温两次超过37.5℃（D错）。